在选择和确定疾病的诊疗方案时，告知患者病情并最终由其决定，体现的是
A. 协同一致原则
B. 有利原则
C. 患者至上原则
D. 知情同意原则
E. 最优化原则

正确答案：D。知情同意原则

解析：在临床过程中，医务人员为患者做出诊断和治疗方案后，应当向患者提供包括诊断结论，治疗决策，病情预后以及诊治费用等方面的真实、充分的信息，尤其是诊疗方案的性质、作用、依据、损伤、风险以及不可预测的意外情况，使患者或其家属经过深思熟虑自主地做出选择，并以相应的方式表达其接受或者拒绝此种诊疗方案的意愿和承诺（D对）。